天疱疮组织病理特征是
A. 上皮增厚，上皮细胞内水肿
B. 不典型增生
C. 基底细胞层液化变性，固有层淋巴细胞浸润带
D. 棘层松解
E. 上皮下疱

正确答案：D。棘层松解

解析：本题考查天疱疮的病理变化。天疱疮组织病理特征为棘层松解（D对）和上皮内疱形成。白色水肿的组织病理特征是上皮增厚，上皮细胞内水肿（A错）。不典型增生为白斑伴有上皮异常增生时的组织病理特征（B错）。基底细胞层液化变性，固有层淋巴细胞浸润带为扁平苔藓的组织病理特征（C错）。上皮下疱为良性黏膜类天疱疮的组织病理特征（E错）。